同种动物接触毒物吸收速度和毒性大小的顺序正确的是
A. 静脉注射﹥肌内注射﹥腹腔注射﹥经口﹥经皮
B. 腹腔注射﹥静脉注射﹥肌内注射﹥经口﹥经皮
C. 静脉注射﹥肌内注射﹥腹腔注射﹥经皮﹥经口
D. 静脉注射﹥腹腔注射﹥肌内注射﹥经口﹥经皮
E. 腹腔注射﹥静脉注射﹥肌内注射﹥经皮﹥经口

正确答案：D。静脉注射﹥腹腔注射﹥肌内注射﹥经口﹥经皮

解析：本题考查化学物暴露途径的吸收速度和毒性大小的顺序。同种动物接触毒物吸收速度和毒性大小的顺序是：静脉注射＞腹腔注射>肌内注射＞经口＞经皮（D对ABCE错）。